患者女，6岁，下颌恒中切牙舌侧萌出2/3，下颌乳中切牙Ⅱ度松动。诊断应为
A. 下中切牙异位萌出
B. 下前牙拥挤
C. 下乳中切牙替换期松动
D. 下中切牙早萌
E. 下乳中切牙滞留

正确答案：E。下乳中切牙滞留

解析：本题考查乳牙滞留的诊断。患者女，6岁，下颌恒中切牙舌侧萌出2/3（恒牙于舌侧萌出），下颌乳中切牙Ⅱ度松动（乳中切牙已有牙根吸收）。综合考虑，应诊断为下乳中切牙滞留（E对）。乳牙滞留诊断的依据是：已到达替换时期尚未替换的乳牙，而且该乳牙根部或唇、颊、舌侧又有继承恒牙萌出。也有因无继承恒牙而致先行乳牙长久滞留于牙列中，乃至呈现在恒牙列中。牙齿异位萌出（A错）指恒牙在萌出过程中未在牙列的正常位置萌出，多发生于上颌尖牙和上颌第一恒磨牙；牙齿早萌（D错）指牙齿萌出时间超前于正常萌出时间，且萌出牙齿的牙根发育不完全，恒牙早萌多见于前磨牙；该病例并未体现下前牙拥挤（B错），下乳中切牙替换期松动（C错）只是该病例的其中一个临床表现，并不是该病例的诊断。